鼓膜是一半透明薄膜，分隔外耳与中耳，能感应很宽频谱内的微小声压变化，并将声音空气传递转变为机械振动。临床上检查成人鼓膜时，须将耳廓拉向
A. 前上
B. 前下
C. 后上
D. 后下
E. 上

正确答案：C。后上

解析：检查鼓膜时，成人需将耳郭向后上方（C对）牵拉，使外耳道变直，方可窥见。婴儿鼓膜近于水平位，检查时须将耳郭拉向后下方（D错）。